临床应用中，抗精神病药氯丙嗪可产生锥体外系副作用，其原因是
A. 该药物结构中含有毒性基团
B. 该药物与非治疗部位靶标结合
C. 该药物与治疗部位靶标结合
D. 该药物激动N₂胆碱受体
E. 该药物在体内代谢产生醌类毒性代谢物

正确答案：B。该药物与非治疗部位靶标结合

解析：本题考查药物结构与毒副作用。药物的不良反应和安全性问题源于两个方面，一是由于药物与非靶标结合引发的副作用；二是由于药物在体内发生代谢作用，生成有反应活性的物质，引发毒性作用。最典型的药物与非治疗部位靶标结合（B对）产生副作用的例子是经典的抗精神病药物产生的锥体外系副作用，如氯丙嗪。